个别交谈是
A. 致力于帮助并鼓励人们有达到健康状态的愿望，知道怎样做才能达到这样的目的，促进每个人或集体努力做好本身应做的一切，知道在必要时如何寻求适当的帮助
B. 其目的是使人认识到并能终生保持口腔健康，通过采用教育手段促使人们主动采取利于口腔健康的行为
C. 为改善环境使之适合于保护口腔健康或使行为有利于口腔健康采取的各种行政干预、经济支持和组织保证等措施
D. 就口腔健康问题与预防保健问题与患者、领导、家长、居委会成员、保健人员进行交谈、讨论的方法
E. 属于街道居民区、乡村及社会团体与单位的活动，旨在使人们提高对口腔健康的认识，引起兴趣，产生强烈的口腔健康愿望

正确答案：D。就口腔健康问题与预防保健问题与患者、领导、家长、居委会成员、保健人员进行交谈、讨论的方法

解析：个别交谈：口腔专业人员就口腔健康问题与预防保健问题与就诊患者、单位领导、儿童家长、社区保健人员等进行交谈、讨论。由于此方式是双向的信息交流，交谈针对性强，讨论比较深入，效果好。掌握“口腔健康教育”知识点。